关于张力性气胸的叙述不正确的是
A. 有皮下气肿
B. 急救须立即在锁骨中线第2肋间用粗针穿刺减压
C. 最严重的气胸类型
D. 胸腔内压进行性增高
E. 常引起纵隔扑动

正确答案：E。常引起纵隔扑动

解析：张力性气胸以胸内压增高，纵隔移位为主要表现，扑动比较少见，若是胸膜或肺组织广泛性受损时引起张力性气胸，可有纵膈扑动。掌握“气胸”知识点。